艾滋病在口腔黏膜最典型的损害之一是
A. 人类乳头瘤病毒
B. 人类免疫缺陷病毒
C. 口腔白色念珠菌感染
D. 唇疱疹
E. 口腔毛状白斑

正确答案：E。口腔毛状白斑

解析：本题考查艾滋病的临床表现。艾滋病在口腔黏膜最典型的损害之一是口腔毛状白斑（E对）。毛状白斑被认为是患者全身免疫严重抑制的征象之一，主要见于HIV感染者，少数可见于骨髓或器官移植后的患者，双侧舌缘呈白色或灰白斑块，有的可蔓延至舌背和舌腹，在舌缘呈垂直皱褶外观，如过度增生则成毛茸状，不能被擦去。人类乳头瘤病毒（A错）可导致各种疣和肿瘤。人类免疫缺陷病毒（B错）是艾滋病的致病微生物。口腔白色念珠菌感（C错）染会导致口腔念珠菌病。唇疱疹（D错）是艾滋病最初的口腔表现。以上三个均不是口腔黏膜损害。